患者，男，48岁。确诊慢性粒细胞性白血病已2年半，服用白消安治疗效果较好。近期出现乏力，低热，鼻衄。检查：脾大，肋缘下6cm，血红蛋白70g/L，外周血原始粒细胞比例大于20%。应首先考虑的是
A. 脾功能亢进
B. 慢粒急变
C. 合并肺结核
D. 骨髓抑制
E. 急性溶血

正确答案：B。慢粒急变

解析：患者低热，脾大，肋缘下6cm，血红蛋白70g/L，外周血原始粒细胞比例大于20%，可以判断为慢粒急变（B对）。脾功能亢进（A错）以血细胞减少为主要表现。合并肺结核（C错）患者可见低热，盗汗，乏力，消瘦等全身中毒症状和咳嗽，咳痰，咯血等呼吸系统症状。骨髓抑制（D错）常最先表现为白细胞下降，血小板平均生存期约为5到7天，其下降出现较晚较轻，，红细胞平均生存期为120天，下降通常不明显，常见于化疗后表现。急性溶血（E错）可见寒战，发热，心悸，胸痛，腰背痛，呼吸困难，甚至发生休克。